女，22岁，颈前肿物3个月。查体：右叶甲状腺可触及一质硬结节，直径2cm。同侧颈淋巴结可及2个，质中，活动。B型超声：甲状腺右叶一低回声实性团块。为明确肿物良恶性，下列各项检查，首先应选择
A. 同位素扫描
B. 血清降钙素测定
C. 针吸细胞学检查
D. 颈部软组织像
E. 右侧颈淋巴结活检

正确答案：C。针吸细胞学检查

解析：青年女性患者，颈前肿物3个月（提示病变进展较快）。体查：右叶甲状腺可触及一质硬结节，直径2cm（肿物较大，提示肿块为恶性病变的可能性大）；同侧颈淋巴结可及2个，质中，活动（提示病变出现颈部淋巴结转移）。影像学检查：B超示甲状腺右叶一低回声实性团块。综合该患者的病史、体查及影像学检查，诊断考虑甲状腺肿瘤伴颈部淋巴结转移。为明确肿物良恶性，首选针吸细胞学检查（C对）。通过细针直接刺入肿物内，吸取少量细胞作细胞学诊断，其方法简单易行，且准确率高达80%以上。同位素扫描（A错）只能了解肿块聚碘情况，一般不作为鉴别良恶性的依据。降钙素由甲状腺滤泡旁细胞合成分泌，血清降钙素测定（B错）多用于甲状腺髓样癌的分型诊断。颈部软组织像（D错）仅能显示占位性病变，并不能明确肿物良恶性。右侧颈淋巴结活检（E错）能了解淋巴结病变的性质，但并不能明确原发病灶肿物良恶性。